黄芪甲苷的构型是
A. 甾体皂苷
B. 三萜皂苷
C. 强心苷
D. 环烯迷萜
E. 黄酮苷

正确答案：B。三萜皂苷

解析：本题考查的是黄芪甲苷的结构。黄芪甲苷的构型是三萜皂苷（B对）。黄芪中的化学成分众多，主要含皂苷类、黄酮类、多糖类及氨基酸类等。药理试验表明，黄芪皂苷具有多种生物活性，其中黄芪甲苷是黄芪中主要生理活性成分，具有抗炎、降压、镇痛、镇静作用，并能促进再生肝脏DNA合成和调节机体免疫功能。黄芪及其同属近缘植物中共分离出40余种三萜皂苷，其结构为四环三萜及五环三萜苷类。知母中的化学成分主要为甾体皂苷（A错）和芒果苷，还含有木脂素、甾醇、鞣质、胆碱等成分。香加皮中含有的强心苷（C错）类化合物为甲型强心苷，其中杠柳毒苷和杠柳次苷为其主要成分。环烯醚萜（D错）类为臭蚁二醛的缩醛衍生物，属单萜类化合物。环烯醚萜类化合物在中药中分布较广，特别是在玄参科、茜草科、唇形科及龙胆科中较为常见。肿节风主要含有酚类、鞣质、黄酮苷（E错）、香豆素和内酯类化合物。